毒性噬菌体的增殖过程顺序正确的是
A. 吸附、穿入与脱壳、生物合成、释放
B. 释放、吸附、穿入与脱壳、生物合成
C. 吸附、生物合成、穿入与脱壳、释放
D. 释放、穿入与脱壳、生物合成、吸附
E. 吸附、释放、生物合成、穿入与脱壳

正确答案：A。吸附、穿入与脱壳、生物合成、释放

解析：毒性噬菌体在宿主菌体内复制增殖，产生许多子代噬菌体，并最终裂解细菌。因此，毒性噬菌体的增殖方式是复制，其增殖过程经吸附、穿入与脱壳、生物合成和成熟释放四个阶段，构成毒性噬菌体一个复制周期称为溶菌性周期。掌握“噬菌体性状及分类”知识点。